根据Kennedy分类法，8765|278缺失属于
A. 第一类第一亚类
B. 第一类第二亚类
C. 第二类第一亚类
D. 第二类第二亚类
E. 第三类第一亚类

正确答案：A。第一类第一亚类

解析：本题考查Kennedy牙列缺损分类。8765|278缺失是双侧后牙缺失，远中无天然牙存在，属于第一类；前牙部分缺失2，有一个缺隙，属于第一亚类（A对B错）。第二类第一亚类（C错）指牙弓一侧后部牙缺失，远中无天然牙存在且还存在一个缺牙间隙。第二类第二亚类（D错）指牙弓一侧后部牙缺失，远中无天然牙存在且还存在两个缺牙间隙。第三类第一亚类（E错）指牙弓的一侧牙缺失，缺隙两端均有天然牙存在且还存在一个缺牙间隙。